原发性肾小球疾病的病理分型不包括
A. 轻微肾小球病变
B. 局灶性节段性病变
C. 肾病综合征
D. 膜性肾病
E. 增生性肾炎

正确答案：C。肾病综合征

解析：肾病综合征（C错，为本题正确答案）是肾小球肾炎临床表现类型之一，不属于病理分型。原发性肾小球疾病的病理分型包括轻微肾小球病变（微小病变性肾小球肾炎）（A对）、局灶性节段性病变（B对）、膜性肾病（D对）、增生性肾炎（膜增生性肾小球肾炎和系膜增生性肾小球肾炎）（E对）。